男，10岁。上课时突然见讲台上老师变成“数寸长短的小人”，约5～10秒后此现象消失。伴随不自主发笑，事后不能回忆发笑之事。3周内反复发作9次。查体和头颅MRI未见异常。可能的癫痫发作类型是
A. 单纯运动性发作
B. 单纯部分性发作
C. 复杂部分性发作
D. 单纯感觉性发作
E. 失神发作

正确答案：C。复杂部分性发作

解析：患者10岁儿童，上课时突然见讲台上老师变成“数寸长短的小人”（错觉），约5-10秒后此现象消失，伴随不自主发笑（情感障碍，欣快），事后不能回忆发笑之事（意识障碍），3周内反复发作9次，查体和头颅MRI未见异常（提示无器质性疾病），可判断为精神性发作，但精神性发作又常为复杂部分性发作的先兆，因此可能的癫痫发作类型是复杂部分性发作（C对）。单纯部分性发作（B错）分为四型，均无意识障碍。其中单纯运动性发作（A错）主要表现为肢体或面部等处的不自主抽动。单纯感觉性发作（D错）主要表现为肢体麻木感和针刺感等症状。失神发作（E错）主要表现为突然意识丧失、呼之不应、双眼茫然凝视等症状。